滴眼剂的质量要求中，哪一条与注射剂的质量要求不同
A. 有一定的pH值
B. 与泪液等渗
C. 无菌
D. 澄明度符合要求
E. 无热原

正确答案：E。无热原

解析：本题考查滴眼剂。无热原（E错，为本题正确答案）属于注射剂的质量要求，但不属于滴眼剂的质量要求；眼用液体制剂的质量要求类似于注射剂，在pH值（A对）、渗透压（B对）、（C对）和澄明度（D对）等方面都有相应的要求。